以下药物的鉴别反应是:黄体酮
A. 与碱性酒石酸铜试液反应生成红色沉淀
B. 用醇制氢氧化钾水解后测定熔点进行鉴别
C. 与亚硝基铁氰化钠反应显蓝紫色
D. 与硝酸银试液反应生成白色沉淀
E. 与铜吡啶试液反应显绿色

正确答案：C。与亚硝基铁氰化钠反应显蓝紫色